麻醉上颌前牙腭侧牙龈、黏骨膜和牙槽骨应阻滞
A. 鼻腭神经
B. 腭前神经
C. 眶下神经
D. 上牙槽前神经
E. 上牙槽中神经

正确答案：A。鼻腭神经

解析：鼻腭神经阻滞麻醉区域：两侧尖牙腭侧连线前方的牙龈，腭侧黏骨膜和牙槽骨。掌握“颌面部常用局麻法及牙拔除的麻醉选择”知识点。